急性胰腺炎并发胰腺脓肿的时间是起病后
A. 1周
B. 2～3周
C. 4～5周
D. 6～7周
E. 8～9周

正确答案：B。2～3周